随着大数据时代的到来和组学技术的发展，作为病因学研究的引领方向是
A. 生态流行病学
B. 系统流行病学
C. 遗传流行病学
D. 行为流行病学
E. 药物流行病学

正确答案：B。系统流行病学

解析：本题考查流行病学发展史。随着大数据时代的到来和组学技术的发展，系统流行病学（B对ACDE错）成为病因学研究的引领方向。系统流行病学是一种进行疾病危险因素风险识别的流行病学方法，不是传统流行病学方法的替代，而是一种补充和完善，且具有传统流行病学所不具备的优势。系统流行病学是传统遗传学和分子流行病学的整合，是机体内环境与疾病发生之间关系的研究；是传统行为危险因素流行病学和健康环境决定因素的整合，寻找疾病危险因素与环境的交互作用；是数据计算方法研究与流行病学研究的整合，通过建模反映观察到的危险因素之间、危险因素与环境因素之间、因素与疾病之间的复杂作用与关系，为疾病预防、预警、预测提供科学依据。系统流行病学的研究内容包括：系统水平（如各种组学）的暴露测量；涉及可能影响健康和疾病的行为、社会人口学和群体水平以及生态环境和进化因素等多层面因素的分析；危险因素之间相互关系的网络分析；疾病发生风险的统计学模型的建立以及未来风险状况的计算模拟和预警预测。系统流行病学的方法适应多维度的数据、多样的数据类型，构建整合的模型，允许信息在不同维度上流动，全面理解生物系统。